可用于筛检项目中远期生物学效果评价的指标有
A. 灵敏度、特异度、符合率、归因死亡率
B. Kappa值、阳性预测值、保护率、病死率
C. 早诊/早治率、需筛检人数、保护率、复发率
D. 归因死亡率、复发率、生存时间
E. 发病率预测值、似然比、归因死亡率

正确答案：D。归因死亡率、复发率、生存时间

解析：本题考查筛检中生物学效果评价指标。生物学效果评价是根据筛查能改善疾病的中间或终末结局状态（发病或预后）的观察终点来设定的，通常采用率为指标。远期生物学效果评价的指标主要有归因死亡率、复发率、生存率和生存时间（D对ABCE错）、治愈率、病死率。